下列属于躯干肌的是
A. 斜方肌
B. 旋前圆肌
C. 梨状肌
D. 冈上肌
E. 三角肌

正确答案：A。斜方肌

解析：斜方肌（A对）属于背肌，也属于躯干肌。旋前圆肌（B错）属于前臂肌。梨状肌（C错）属于髋肌。冈上肌（D错）和三角肌（E错）属于上肢带肌。